根面平整的“短刮连刮”要求
A. 每一刮治动作不能间断
B. 每一刮治动作之间要有重叠
C. 器械刮治时应用指力
D. 刮治动作频率要快
E. 以上都是

正确答案：B。每一刮治动作之间要有重叠

解析：本题考查根面平整术。根面平整 “短刮连刮”要求是指每刮一下应与前一下有所重叠（B对），以免遗漏牙石。根面平整术是在做龈下刮治时，必须同时刮除牙根表面感染的病变牙骨质，并使部分嵌入牙骨质内的牙石和毒素也能得以清除，使刮治后的根面光滑而平整。其操作要点是先探明牙周袋形态和深度、龈下牙石的量和部位，使用锐利的龈下刮治器，以提高效率。以改良握笔式手持器械，稳妥的支点，动作幅度要小，频率不可过快（D错），避免滑脱或损伤软组织刮治时应用腕力（C错）。每一刮治动作之间可以间断（A错）。为避免遗漏所需刮治的牙位，应分区段按牙位逐个刮治，对于中重度牙周炎患者，尤其是从未做过牙周治疗的患者，则需分次分象限完成全口刮治。